下列溶剂中，极性最强的是
A. 甲醇
B. 乙醇
C. 氯仿
D. 水
E. 乙酸乙酯

正确答案：D。水

解析：本题考查的是常用溶剂的极性。下列溶剂中，极性最强的是水（D对）。常用溶剂的极性大小的排列顺序由强到弱为：水、甲醇（A错）、乙醇（B错）、乙酸乙酯（E错）、氯仿（三氯甲烷）（C错）、乙醚（无水）、苯、己烷。